患者，女性，54岁。左上后牙持续性疼痛2个月，与冷热刺激无关，偶感牙龈麻胀，近来自觉开口受限，无复视。对于该患者影像检查中对上颌窦癌定位诊断价值不大的是
A. CT
B. 颅底平片
C. 上颌侧位体层片
D. 上颌正位体层片
E. 华氏位

正确答案：B。颅底平片

解析：本题考查上颌窦癌的影像学检查。从该病例中“左上后牙持续性疼痛，2个月，与冷热刺激无关”、“ 牙龈麻胀，近来自觉开口受限，无复视”，可推测肿瘤发生自上颌窦下壁及后壁。颅底平片（B错，为本题的正确答案）主要显示颅底情况，虽然可以显示两侧上颌窦，但是因显示的结构过多，尤其是上颌窦后壁处影像重叠较明显，故对于上颌窦癌定位诊断价值不大。上颌侧位体层片（C对）可显示矢状断面上颌窦、翼腭窝、翼突、上颌牙槽骨及磨牙列影像，常用于检查上颌骨、上颌窦、翼腭窝及颞下窝病变。上颌正位体层片（D对）常用于观察上颌病变及其与上颌窦、筛窦、眶底、鼻腔和颅底的关系，以确定上颌肿瘤是否累及翼突及颅底。华氏位（E对）主要用来观察鼻窦的情况，特别是上颌窦影像显示最佳。CT（A对）图像清晰，定位准确，对于上颌窦癌的定位具有重要意义。